根据《野生药材资源保护管理条例》，国家一级保护野生药材物种是指
A. 资源严重减少的主要常用野生药材物种
B. 分布区域缩小的重要野生药材物种
C. 资源处于衰竭状态的重要野生药材物种
D. 濒临灭绝状态的稀有珍贵野生药材物种
E. 用于预防和治疗特殊疾病的重要野生药材物种

正确答案：D。濒临灭绝状态的稀有珍贵野生药材物种

解析：本题考查的是国家重点保护野生药材物种的分级。根据《野生药材资源保护管理条例》国家一级保护野生药材物种是指濒临灭绝状态的稀有珍贵野生药材物种（D对）。国家重点保护野生药材物种的分级：国家重点保护的野生药材物种分为三级管理。一级保护野生药材物种：系指濒临灭绝状态的稀有珍贵野生药材物种。二级保护野生药材物种：系指分布区域缩小，资源处于衰竭状态的重要野生药材物种（BC错）。三级保护野生药材物种：系指资源严重减少的主要常用野生药材物种（A错）。